作用持续时间最久的长效β₂受体激动剂，治疗夜间哮喘发作的是
A. 沙丁胺醇
B. 克仑特罗
C. 特布他林
D. 福莫特罗
E. 沙美特罗

正确答案：D。福莫特罗